关于硝酸酯类药物合理使用的说法，正确的有
A. 单硝酸异山梨酯口服吸收完全，无肝脏首关效应、生物利用度
B. 硝酸异山梨酯主要的药理作用源于其活性代谢产物5-单硝酸异山梨酯
C. 为减缓耐药性的发生，应采用偏心给药方法，即每天有8～12小时无药期
D. 禁止与5型磷酸二脂酶抑制剂合用
E. 硝酸甘油舌下给药是治疗心绞痛急性发作的首选措施

正确答案：A、B、C、D、E。单硝酸异山梨酯口服吸收完全，无肝脏首关效应、生物利用度；硝酸异山梨酯主要的药理作用源于其活性代谢产物5-单硝酸异山梨酯；为减缓耐药性的发生，应采用偏心给药方法，即每天有8～12小时无药期；禁止与5型磷酸二脂酶抑制剂合用；硝酸甘油舌下给药是治疗心绞痛急性发作的首选措施

解析：本题考查硝酸酯类药物。单硝酸异山梨酯在胃肠道吸收完全，无肝脏首关效应，生物利用度近100%（A对）。硝酸异山梨酯主要的药理学作用源于肝脏的活性代谢产物5-单硝酸异山梨酯（B对）。硝酸酯耐药现象具有剂量和时间的依赖，每日提供8～12h无药期（C对）。硝酸酯类药物在用药期间禁止联合5型磷酸二脂酶抑制剂（D对）。硝酸甘油舌下含服是治疗心绞痛急性发作的首选（E对）。